一项膀胱癌与吸烟关系的前瞻性队列研究中，发现男性吸烟者膀胱癌发病率为48.0/10万，不吸烟者为25.4/10万，其相对危险度为
A. 1.89
B. 22.6/10万
C. 48
D. 0.0048

正确答案：A。1.89

解析：本题考查相对危险度的计算。相对危险度是暴露组的危险度（测量指标是累积发病率）与对照组的危险度之比。计算为相对危险度＝（48.0/10万）/（25.4/10万）＝1.89（A对BCD错）。